双胍类降血糖药物的降糖作用机制是
A. 抑制肝糖原的分解
B. 增加基础胰岛素的分泌量
C. 改变餐时胰岛素的分泌模式
D. 延缓肠道碳水化合物的吸收
E. 激活过氧化物酶增殖体活化因子受体

正确答案：A。抑制肝糖原的分解

解析：双胍类降血糖药物的降糖作用机制是抑制肝糖原的分解（A对）。增加基础胰岛素的分泌量是磺酰脲类降糖药的降糖机制（B错）。改变餐时胰岛素的分泌模式为干扰选项（C错）。延缓肠道碳水化合物的吸收是α葡萄糖苷酶抑制剂的降糖机制（D错）。激活过氧化物酶增殖体活化因子受体是噻唑烷二酮类药物的降糖机制（E错）。